下列属于双面嵌体的是
A. （牙合）面嵌体
B. 邻（牙合）嵌体
C. 颈部嵌体
D. 邻（牙合）舌嵌体
E. 高嵌体

正确答案：B。邻（牙合）嵌体

解析：本题考查嵌体的分类。下列属于双面嵌体的是邻（牙合）嵌体（B对）。根据嵌体覆盖牙面数目和位置分类：（1）单面嵌体：如（牙合）面嵌体、颊面嵌体、邻嵌体等。（2）双面嵌体：如近中（牙合）嵌体（简称为MO嵌体），远中（牙合）嵌体（OD嵌体），颊（牙合）嵌体（BO嵌体），舌（牙合）嵌体（LO嵌体）。（3）多面嵌体：如邻（牙合）邻嵌体（简称MOD嵌体），颊（牙合）舌嵌体（简称BOL嵌体）等。（牙合）面嵌体（A错）属于单面嵌体。颈部嵌体（C错）属于单面嵌体。邻（牙合）舌嵌体（D错）属于多面嵌体。